21岁女性患者，2周前因6∣可复性牙髓炎来院做间接盖髓术，术后冷水敏感加重，叩诊（+），近日偶有自发痛，复诊时应如何处理
A. X线片检查
B. 电活力测验
C. 去暂充物，重新盖髓
D. 牙髓治疗
E. 不处理，继续观察

正确答案：D。牙髓治疗

解析：本题考查不可复性牙髓炎的治疗。不可复性牙髓炎有自发痛的症状，应做牙髓治疗（D对E错）；X线片检查（A错）和电活力测验（B错）是常规检查，不是处理措施；可复性牙髓炎温度刺激敏感，冷刺激一过性疼痛，刺激去除立即消失，无自发痛，应去除暂充物，以氢氧化钙垫底安抚，重新盖髓，密切观察，若无症状，则护髓成功（C错）。